男，18岁，左下肢跛行15年，查体发现左侧马蹄内翻足畸形，胫前肌有轻度肌收缩，但不能产生关节运动，其肌力为
A. 0级
B. 1级
C. 2级
D. 3级
E. 5级

正确答案：B。1级

解析：肌力的记录采用0～5级的六级分级法：0级（A错）为完全瘫痪，测不到肌肉收缩；1级（B对）为仅测到肌肉收缩，但不能产生动作，结合患者的临床表现，与该级表现相符；2级（C错）肢体在床面上能水平移动，但不能抵抗自身重力，即不能抬离床面；3级（D错）肢体能抬离床面，但不能抗阻力；4级指能作抗阻力动作，但不完全；5级（E错）为正常肌力。